属于血管紧张素转换酶抑制剂的是
A. 伯氨喹
B. 琥珀胆碱
C. 异烟肼
D. 氯沙坦
E. 依那普利

正确答案：E。依那普利

解析：本题考查血管紧张素转换酶抑制药。常用的血管紧张素转换酶抑制药包括：卡托普利、阿拉普利、依那普利（E对）、依那普利拉、贝那普利等。